左心衰竭发生呼吸困难的主要机制是
A. 肺淤血
B. 肺泡张力增加
C. 肺泡弹性减退
D. 肺循环压力升高
E. 以上都不是

正确答案：A。肺淤血

解析：心源性呼吸困难主要由左心衰竭引起，左心衰发生呼吸困难的主要原因是肺淤血（A对E错）、肺泡弹性及肺顺应性降低。肺淤血是左心衰竭发生呼吸困难的主要机制，此时呼吸膜厚度增加，气体弥散功能降低，体内缺氧，引起呼吸困难。肺泡张力增加（B错），刺激牵张感受器，通过迷走神经反射兴奋呼吸中枢。肺泡弹性减退（C错），扩张与收缩能力降低，肺活量减少。肺循环压力升高（D错）对呼吸中枢的反射性刺激，引起呼吸加快。但是BCD都不是最主要的机制。